治疗癫痫大发作宜选用的药物是
A. 扑米酮
B. 苯妥英钠
C. 地西泮（静脉注射）
D. 乙琥胺
E. 卡马西平

正确答案：B。苯妥英钠

解析：本题考查抗癫痫药的选用。癫痫大发作的首选药是苯妥英钠（B对）。